主要不是经输血传播的病毒是
A. 乙型肝炎病毒
B. 人免疫缺陷病毒
C. 乙型脑炎病毒
D. 丙型肝炎病毒
E. 巨细胞病毒

正确答案：C。乙型脑炎病毒